摩擦剂约占牙膏含量的
A. 1%～2%
B. 2%～3%
C. 20%～40%
D. 20%～60%
E. 0.1%～0.5%

正确答案：D。20%～60%

解析：摩擦剂约占牙膏含量的20%～60%。常用的摩擦剂有碳酸钙、焦磷酸钙、磷酸氢钙、氢氰化铝、二氧化硅、硅酸盐等。掌握“自我口腔保健方法”知识点。